目前已公认牙周炎是
A. 多因素致病的感染性疾病
B. 与遗传有关的疾病
C. 伴有细菌感染的组织变性
D. 牙合创伤是主要致病因素之-
E. 由细菌及其产物导致的疾病

正确答案：A。多因素致病的感染性疾病

解析：本题考查牙周炎。目前已公认的牙周炎是一种由菌斑生物膜等多因素所引起的感染性的疾病（A对）而不是伴有细菌感染的组织变性（C错）。菌斑微生物在牙周病的发病过程中是必须的因素，但其单独存在并不意味着牙周病必然发生，在一些引起牙周病的危险因素共同作用下最终导致牙周病的发生。遗传（B对）、（牙合）创伤（D对）被认为是牙周炎的危险因素，在一定程度上能促进牙周炎的发生。牙周炎是由多种因素引起的，由细菌及其产物导致的疾病（E错）的说法太片面。